虚寒呃逆的主要临床症状有
A. 气弱无力
B. 呃声低沉而长
C. 呃声高亢而短
D. 呃声响而有力
E. 有酸腐气味

正确答案：A、B。气弱无力；呃声低沉而长

解析：本题考查的是虚寒呃逆的临床症状。虚寒呃逆的主要临床症状有气弱无力（A对）、呃声低沉而长（B对）。呃逆，俗称“打呃”。呃声高亢而短（C错）、响亦有力（D错），多属实热。呃声低沉而长、气弱无力，多属虚寒。日常的打呃，呃声不高不低，无其他不适，多为食后偶然触犯风寒，或因咽食急促所致，不属病态。若久病胃气衰败，出现呃逆、声低无力，则属危证。嗳气，又称噫气，俗名打嗝，多见于饱食后。嗳气，可由宿食不化、肝胃不和、胃虚气逆等原因引起。食后嗳出酸腐气味（E错），多为宿食停积，或消化不良；无酸腐气味的，则为肝胃不和或胃虚气逆所致。